某项队列研究得出的相对危险度为1.5，95%的可信限为1.1～2.8，下列哪种说法不正确
A. 该暴露因素是危险因素
B. 暴露组的发病危险是对照组的1.5倍
C. 暴露组的发病危险比对照组高
D. 暴露与疾病的关联为正关联
E. 归因危险度为28%

正确答案：E。归因危险度为28%

解析：本题考查相对危险度和归因危险度的特点。根据题意可得出，该暴露是危险因素（A对）；暴露组的发病危险是对照组的1.5倍（B对）；暴露组的发病危险比对照组高（C对）；暴露与疾病的关联为正关联（D对）。归因危险度根据上述条件无法计算（E错，为本题正确答案）。